根据《反不正当竞争法》，丙化妆品生产企业夸大其商品的性能、功能、质量和销售状况，美化用户评价，虚构曾获荣誉的行为
A. 侵犯商业秘密行为
B. 混淆行为
C. 诋毁商誉行为
D. 虚假商业宣传行为

正确答案：D。虚假商业宣传行为

解析：本题考查不正当竞争行为。根据《反不正当竞争法》，丙化妆品生产企业夸大其商品的性能、功能、质量和销售状况，美化用户评价，虚构曾获荣誉的行为是虚假商业宣传行为（D对）。《反不正当竞争法》第八条规定，经营者不得对其商品的性能、功能、质量、销售状况、用户评价、曾获荣誉等作虚假或者引人误解的商业宣传，欺骗、误导消费者。经营者不得通过组织虚假交易等方式，帮助其他经营者进行虚假或者引人误解的商业宣传。《反不正当竞争法》第九条规定，经营者不得实施下列侵犯商业秘密的行为（A错）：（一）以盗窃、贿赂、欺诈、胁迫或者其他不正当手段获取权利人的商业秘密；（二）披露、使用或者允许他人使用以前项手段获取的权利人的商业秘密；（三）违反约定或者违反权利人有关保守商业秘密的要求，披露、使用或者允许他人使用其所掌握的商业秘密。《反不正当竞争法》第六条规定，经营者不得实施下列混淆行为（B错），引人误认为是他人商品或者与他人存在特定联系：（一）擅自使用与他人有一定影响的商品名称、包装、装潢等相同或者近似的标识；（二）擅自使用他人有一定影响的企业名称（包括简称、字号等）、社会组织名称（包括简称等）、姓名（包括笔名、艺名、译名等）；（三）擅自使用他人有一定影响的域名主体部分、网站名称、网页等；（四）其他足以引人误认为是他人商品或者与他人存在特定联系的混淆行为。《反不正当竞争法》第十一条规定，经营者不得编造、传播虚假信息或误导性信息，损害竞争对手的商业信誉、商品声誉（C错）。